针灸治疗面瘫经常采用地仓透
A. 颊车
B. 迎香
C. 水沟
D. 下关
E. 大迎

正确答案：A。颊车

解析：针灸治疗面瘫口角歪斜、流涎、面痛等局部病证，经常采用地仓透颊车（A对）。迎香（B错）主治鼻塞等鼻病；口歪、面痒等面部病症；胆道蛔虫症。操作时略向内上方斜刺或平刺0.3-0.5寸。水沟（C错）主治急危重症；神志病症；鼻塞、鼻衄、面肿、口歪、齿痛、牙关紧闭等面鼻口部病症；闪挫腰痛。操作时应向上斜刺0.3-0.5寸，强刺激，或指甲掐按。下关（D错）主治牙关不利、面痛、齿痛、口眼歪斜等面口病症；耳聋、耳鸣、聤耳等耳疾。操作时应直刺0.5-1寸。留针时不可做张口动作，以免弯针、折针。大迎（E错）主治口角歪斜、颊肿、齿痛等局部病症。操作时应避开动脉，斜刺或平刺0.3-0.5寸。